手太阴肺经的起止穴分别是
A. 少商、中府
B. 中府、少商
C. 商阳、中府
D. 中府、商阳
E. 商阳、迎香

正确答案：B。中府、少商

解析：手太阴肺经起于中府止于少商（B对）。手太阴肺经经穴歌：LU十一是肺经，起于中府少商停，胸肺疾患咳嗽喘，咯血发热咽喉痛。中府乳上数三肋，云门锁骨下窝寻，二穴相差隔一肋，距胸中线六寸平，天府腋下三寸取，侠白府下一寸擒，尺泽肘中肌腱外，孔最腕上七寸凭，列缺交叉食指尽，经渠寸口动脉动，大渊掌后横纹上，鱼际大鱼骨边中，少商穴存大指外，去指甲角韭叶明。